阴阳的确切含义是
A. 相互对立的两个事物
B. 事物内部存在的相互对立的两个方面
C. 矛盾的双方
D. 对自然界相互关联的某些事物和现象对立双方的概括
E. 古代的两点论

正确答案：D。对自然界相互关联的某些事物和现象对立双方的概括

解析：本题考查的是阴阳的含义。阴阳的确切含义是对自然界相互关联的某些事物和现象对立双方的概括（D对）。阴阳，是对自然界相互关联的某些事物和现象对立双方属性的概括，即含有对立统一的概念。阴和阳的相对属性引入于医学领域，即把对于人体具有推动、温煦、兴奋等作用的物质和功能，统属于阳；对于人体具有凝聚、滋润、抑制等作用的物质和功能，统属于阴。